以时间为权数规定的8小时工作日的平均容许接触水平是指
A. 生物学接触限值
B. 时间加权平均容许浓度
C. 最高容许浓度
D. 阈限值
E. 短时间接触容许浓度

正确答案：B。时间加权平均容许浓度